对病人自主与医生做主之间的关系的理解正确的是
A. 病人自主与医生做主是对立的
B. 病人自主与医生做主不是对立的
C. 强调病人自主，也充分看到医生做主的存在价值
D. 强调医生决定，兼顾病人自主
E. 强调病人自主，目的在于减轻医生的责任

正确答案：C。强调病人自主，也充分看到医生做主的存在价值

解析：病人自主与医生做主之间不是绝对对立的（AB错），具体临床问题应具体分析，二者要兼顾，既强调病人自主，也充分看到医生做主的存在价值（C对D错）。在以往以义务论为主导的时期，通常在危急关头，医生遵循有利原则，依据自己的专业判断替患者做决定，而忽略病人的自主性。现在通常在强调病人自主的基础上，发挥医生做主的作用，用专业知识加以解释和导向，在特殊时期行使特殊干涉权。强调病人自主，目的在于保护病人自身的利益，而不是减轻医生的责任（E错）。